某患儿被诊断为“注意缺陷多动障碍”。“注意缺陷多动障碍”属于下面哪类心理-行为问题
A. 学业相关问题
B. 情绪问题
C. 品行问题
D. 顽固性不良习惯
E. 广泛性发育障碍

正确答案：A。学业相关问题